关于选磨法描述哪项是正确的
A. 先磨改正中位的早接触点
B. 一次不应磨改太多
C. 根尖有炎症的松动牙应消炎后再磨改
D. 尽量恢复牙齿的球面外形
E. 以上均对

正确答案：E。以上均对

解析：本题考查选磨方法。选磨法是（牙合）治疗的一种方法，即用砂石轮等磨改牙齿外形以消除创伤性（牙合）。选磨方法有：（1）为保持正中（牙合）时稳定的咬合关系，先磨改正中位的早接触点（A对）。（2）由于磨改牙齿的方法是不可逆的，所以一次不应磨改太多（B对）。（3）根尖有炎症的松动牙应消炎后再磨改（C对），因为牙周有炎症时牙可伸长或移位，当炎症消退后，牙周组织有一定的修复，牙齿位置和动度可有所恢复，此时调（牙合）比较准确。（4）尽量恢复牙齿的球面外形（D对），可减少牙间接触面，增加食物溢出道，减少食物嵌塞；恢复牙齿解剖外形，提高咀嚼效率。去除锐利边缘嵴，减轻咬合创伤。（ABCD均对，故E为本题的正确答案）。